龈下非附着菌斑主要由以下细菌构成
A. 革兰阳性球菌、杆菌和丝状菌
B. 革兰阴性厌氧菌、能动菌
C. 革兰阳性兼性菌和厌氧菌
D. 革兰阳性需氧菌和兼性菌
E. 革兰阳性需氧菌和革兰阴性厌氧菌

正确答案：B。革兰阴性厌氧菌、能动菌

解析：本题考查龈下非附着菌斑的细菌构成。非附着性龈下菌斑生物膜主要为革兰阴性厌氧菌，还包括许多能动菌和螺旋体（B对），与牙槽骨的快速破坏有关，与牙周炎的发生发展关系密切。革兰阳性球菌、杆菌及丝状菌（A错）、革兰阳性兼性菌（C错）属于附着性龈下菌斑，与龈下牙石的形成、根面龋、根面吸收及牙周炎有关。革兰阳性需氧菌和兼性菌属于龈上菌斑（D错），与龋病、牙龈炎、龈上牙石有关。